葡萄糖的杂质检查项目是
A. 中性或碱性物质
B. 酮体
C. 对氨基苯甲酸
D. 亚硫酸盐和可溶性淀粉
E. 其他它生物碱

正确答案：D。亚硫酸盐和可溶性淀粉